公共卫生监测本身属于
A. 描述性研究
B. 分析性研究
C. 实验性研究
D. 理论性研究
E. 生态学研究

正确答案：A。描述性研究

解析：本题考查公共卫生监测。公共卫生监测是长期、连续、系统地收集、分析、解释、反馈及利用公共卫生信息的过程，其本身属于描述性研究（A对BCDE错）。